与传导下肢本体感觉相关的结构是
A. 内侧纵束
B. 孤束
C. 薄束
D. 楔束
E. 脊髓丘脑束

正确答案：C。薄束

解析：本体感觉即躯体深感觉，主要包括位置觉和运动觉（九版生理学P260）。与传导本体感觉相关的结构是薄束（下肢）、楔束（上肢）、脊髓小脑束（P54）（C对）。